氯霉素可发生的一种与剂量无关的不良反应是
A. 二重感染
B. 不可逆的再生障碍性贫血
C. 治疗性休克
D. 可逆性各种血细胞减少
E. 灰婴综合征

正确答案：B。不可逆的再生障碍性贫血

解析：本题考查氯霉素的不良反应。氯霉素对造血细胞的影响有两种：与剂量大小无关的不可逆的再生障碍性贫血（B对），，剂量相关的可逆性各种血细胞减少（D错），及时停药有望恢复。二重感染（A错）、治疗性休克（C错）、灰婴综合征（E错）均与剂量有关。